王某，4岁。玩耍时将一小跳棋子误吸卡于喉部，导致严重窒息。其父速将其送至张某开设的中医诊所就诊。张某即刻用桌上的一把水果刀将王某的气管切开，并用手伸入切口将棋子捅出。王某的生命虽得救，但伤口感染。经抗炎治疗后，伤口愈合，瘢痕形成，气管狭窄。张某行为的性质属于
A. 违规操作，构成医疗事故
B. 非法行医，不属于医疗事故
C. 超范围执业，构成医疗事故
D. 见义勇为，不构成医疗事故
E. 在紧急情况下抢救垂危患者的生命，采取紧急医疗措施，虽造成不良后果，但不属于医疗事故。

正确答案：E。在紧急情况下抢救垂危患者的生命，采取紧急医疗措施，虽造成不良后果，但不属于医疗事故。

解析：根据《医疗事故处理条例》，张某在紧急情况下抢救垂危的王某生命，采取紧急医疗措施，虽造成不良后果，但不属于医疗事故（E对）。